患者，男，48岁。近3年来疲劳乏力，食欲减退，间歇性鼻出血，齿龈出血。今晨进硬食后，突然呕血，并出现黑便。检查：血压明显下降，心率120次/分，腹部膨隆，有移动性浊音，肝脾触诊不满意。应首选的止血措施是：
A. 肌注安络血
B. 静滴止血环酸
C. 冰水洗胃
D. 三腔管压迫
E. 迅速补充血容量

正确答案：B。静滴止血环酸

解析：患者中年男性，近年来疲乏、食欲减退（肝功能减退致消化吸收和营养不良），有鼻出血、牙龈出血表现（主要由肝合成凝血因子减少引起），进硬食后突发呕血，出现便血（上消化道出血的典型表现），查体见血压明显下降，心率增快（正常60～100次/分）（考虑有失血性休克），腹部膨隆且有移动性浊音（提示有腹水），综合该患者的病史、体查，该患者诊断考虑为肝硬化并发食管胃底静脉曲张出血，应首选的止血措施是静滴止血环酸（B对），即氨甲环酸（八版药理学P269），此药能抑制纤维蛋白溶解，尽早给予可以及时止血。安络血（A错）主要治疗由毛细血管损伤、通透性增加所致的出血，如视网膜出血、咯血、血尿等，对大量出血治疗效果差。冰水洗胃（C错）仅是暂时性地对症治疗措施，需配合药物共同治疗。三腔管压迫（P455）（D错）在药物治疗无效的大出血时暂时使用。迅速补充血容量（P454）（E错）能防治低血容量性休克，但不属于止血措施。